车前子除能利水通淋、明目外，还能
A. 清心除烦
B. 渗湿止泻
C. 凉血止血
D. 通经下乳
E. 清解暑热

正确答案：B。渗湿止泻

解析：本题考查的是车前子的功能。车前子除能利水通淋、明目外，还能渗湿止泻（B对）。车前子：【功效】利水通淋，渗湿止泻，明目，清肺化痰。灯心草：【功效】利尿通淋，清心除烦（A错）。石韦：【功效】利尿通淋，凉血止血（C错），清肺止咳。木通：【功效】利水通淋，泄热，通经下乳（D错）。滑石：【功效】利尿通淋，清解暑热（E错）；外用清热收湿敛疮。